肝生物转化作用过程不包括
A. 极性增强
B. 进行代谢转变
C. 水溶性提高
D. 易于通过皮肤排出体外
E. 对人体有一定潜在毒性作用

正确答案：D。易于通过皮肤排出体外

解析：人体内存在许多非营养物质，对人体有一定的生物学效应或潜在的毒性作用。机体在排出这些非营养物质之前，需对它们进行代谢转变，使其水溶性提高，极性增强，易于通过胆汁或尿液排出体外。这一过程称为生物转化作用。掌握“肝的生物转化”知识点。